下列关于宣威肺癌高发的原因说法错误的是
A. 活炉灶类型独特多为“火塘”
B. 当地产烟煤含焦油物质较多
C. 燃煤产生的多环芳烃等有害物质浓度高，种类多
D. 工业污染严重
E. 生活炉灶无排烟管道，造成室内空气污染物积聚

正确答案：D。工业污染严重

解析：本题考查宣威肺癌高发的原因。工业污染（D错，为本题正确答案）与宣威肺癌高发无明显联系。宣威肺癌高发的原因有：当地产烟煤含焦油物质较多（B对）；燃煤产生的多环芳烃等有害物质浓度高，种类多（C对）；活炉灶类型独特多为“火塘”（A对）；生活炉灶无排烟管道，造成室内空气污染物积聚（E对）。